哪种细菌最常引起医院感染
A. 革兰阴性杆菌
B. 革兰阳性球菌
C. 革兰阴性球菌
D. 革兰阳性杆菌
E. 厌氧菌

正确答案：A。革兰阴性杆菌

解析：医院感染是指住院患者在医院内获得的感染，在医院感染的病例中，大肠埃希菌位居第一，故答案选择革兰阴性杆菌（A对）。